女，38岁。突然右侧偏瘫3小时，体检：失语，双眼向左凝视，右鼻唇沟浅，伸舌偏右，右侧肌张力低，肌力0级，角膜反射右（-），左（+），腱反射右侧无反应，血压16/10kpa，心率100次/分，心尖区收缩期伴舒张期杂音Ⅱ级，房颤，可能的诊断是
A. 左半球出血
B. 左半球脑栓塞
C. 左半球脑血栓形成
D. 左脑桥出血
E. 右脑桥出血

正确答案：B。左半球脑栓塞

解析：中年女性，突然右侧偏瘫3小时，体检：失语，双眼向左凝视，右鼻唇沟浅，伸舌偏右，右侧肌张力低，肌力0级，角膜反射右（-），左（+），腱反射右侧无反应，血压16/10kpa，心率100次/分，心尖区收缩期伴舒张期杂音Ⅱ级，房颤（脑栓塞的高危因素），根据神经系统的定位诊断，可大体定位至左侧大脑半球，则该患者可能的诊断为左半球脑栓塞（B对）。脑出血（ADE错）常见于50岁以上患者，多有高血压病史，脑出血后多有血压明显升高，常会有出血颅内压增高的相关症状如头痛、呕吐等（P189）。左半球脑血栓形成（C错）起病缓慢，多在睡眠或安静中起病（P177）。